危害最大，且可引起死亡的致泻性大肠杆菌是
A. 肠侵袭性大肠杆菌
B. 肠致病性大肠杆菌
C. 肠产毒性大肠杆菌
D. 肠出血性大肠杆菌
E. 肠聚集性大肠杆菌

正确答案：D。肠出血性大肠杆菌